混合牙列期的恒牙充填修复治疗的主要目的是
A. 恢复牙齿接触点
B. 恢复牙齿解剖外形
C. 恢复牙齿高度
D. A+B
E. A+C

正确答案：B。恢复牙齿解剖外形

解析：本题考查混合牙列期恒牙充填修复治疗的目的。混合牙列期的恒牙充填修复治疗的主要目的是恢复牙齿解剖外形（B对）。混合牙列时期的年轻恒牙在牙列中有活跃的垂直向和水平向的移动度，所以在修复牙体时以恢复牙冠的解剖外形为目的，不强调恢复牙齿间的接触点（ADE错）。年轻恒牙不断萌出，牙齿高度不断发生变化，恢复牙齿高度（C错）不是充填治疗的主要目的。